滴眼剂配制时，使用的溶剂是
A. 自来水
B. 制药纯水
C. 注射用水
D. 灭菌注射用水
E. 饮用水

正确答案：C。注射用水